某医生收集到数据经过统计学家分析应该进行t检验。该医生收集的资料的类型属于
A. 计数资料
B. 定性资料
C. 等级资料
D. 半定量资料
E. 定量资料

正确答案：E。定量资料

解析：统计资料按研究因素（或研究指标）的性质可分为3种类型：①定量因素（定量指标）和计量资料定量因素是对个体的定量特征的描述，有大小和单位，称数值变量，简称变量，其取值为数值，即变量值。②定性因素（定性指标）和计数资料定性因素是对个体的定性特征的描述，有类别。其特点是类别是客观存在的，各类无秩序，可任意排列；类和类之间界线清楚，不会错判。③等级因素（等级指标）和等级资料等级因素是对个体的等级特征的描述，分等级。其特点是级别是主观划分的，各级没有大小，但有秩序，必需自低（或弱）到高（或强）或自高到低排列，故等级因素又可叫做半定量因素；级和级之间界线模糊，可能错判。而进行t检验的数据资料被称为定量资料。掌握“定量资料的统计描述和推断”知识点。